危害性鉴定时，属于有阈值毒物效应的是
A. 致癌效应、生殖细胞突变效应
B. 发育效应、器官/细胞效应
C. 生殖细胞突变效应、发育效应
D. 致癌效应、发育效应
E. 生殖细胞突变效应、器官/细胞效应

正确答案：B。发育效应、器官/细胞效应

解析：本题考查有阈值毒物效应。有阈值毒物效应是指某些毒物对人体产生损害时，需要达到一定的暴露水平才能产生明显的毒物效应。危害性鉴定时，属于有阈值毒物效应的是发育效应、器官/细胞效应（B对ACDE错）。